患儿，5个月。腹泻水样便，每日10余次，尿量少。查体：昏睡，呼吸深快，皮肤弹性极差，前囟及眼窝明显凹陷，四肢凉。实验室检查：二氧化碳结合力10mmol/L。应首先考虑的是
A. 重度脱水，酸中毒
B. 中度脱水，酸中毒
C. 中度脱水
D. 轻度脱水
E. 以上均非

正确答案：A。重度脱水，酸中毒

解析：根据患儿腹泻病史，体液丢失过度，伴尿量偏少，故考虑脱水，结合患儿出现昏睡，皮肤弹性极差，前囟及眼窝明显凹陷，四肢凉，脱水程度应为重度。由于腹泻丢失大量碱性物质；进食量少，热卡不足，肠吸收不良，机体得不到正常能量供应导致脂肪分解增加，产生大量酮体；脱水时血容量减少，血液浓缩，血流缓慢，组织缺氧致乳酸堆积；脱水使肾血流量亦不足，其排酸、保钠功能低下使酸性代谢产物滞留体内，故易产生代谢性酸中毒，目前患儿已出现呼吸深快，化验二氧化碳结合力10mmol/L，提示出现代谢性酸中毒，故本病例应首先考虑重度脱水，酸中毒（A对）。中度脱水为失水量占体重的5～10%（50～100mL/kg），患儿精神萎靡或烦躁不安，皮肤干燥、弹力差；眼窝、前囟明显凹陷；哭时少泪；口唇黏膜干燥；四肢稍凉，尿量明显减少（BC错）。轻度脱水为失水量占体重5%以下（30～50mL/kg），患儿精神正常或稍差；皮肤稍干燥，弹性尚可；眼窝、前囟轻度凹陷；哭时有泪；口唇黏膜稍干；尿量稍减少（D错）。